半夏和天南星除燥湿化痰外还可以
A. 止咳
B. 祛痰
C. 散结
D. 通络
E. 消痞

正确答案：C。散结

解析：本题考查的是半夏和天南星的功效。半夏和天南星除燥湿化痰外还可以散结（C对）。半夏：【功效】燥湿化痰，降逆止呕，消痞（E错）散结。天南星：【功效】燥湿化痰，祛风止痉，散结消肿。川贝母：【功效】清热化痰，润肺止咳（A错），散结消痈。芥子：【功效】温肺祛痰（B错），利气散结，通络（D错）止痛。